某男，75岁。患中风3年。现左侧肢体僵硬拘挛，活动不遂，头痛头晕，面赤耳鸣，舌红，苔薄黄，脉弦。宜选用的中成药是
A. 消栓颗粒
B. 天麻钩藤颗粒
C. 脑心通胶囊
D. 醒脑再造胶囊
E. 通天口服液

正确答案：B。天麻钩藤颗粒

解析：本题考查的是中风的辨证论治。患中风3年。现左侧肢体僵硬拘挛，活动不遂，头痛头晕，面赤耳鸣，舌红，苔薄黄，脉弦。宜选用的中成药是天麻钩藤颗粒（B对）。中风是以猝然昏仆，不省人事，半身不遂，口眼㖞斜，语言不利为主症的疾病。病轻者可无昏仆而仅见半身不遂和口眼㖞斜等症状。西医学的急性脑血管疾病，如脑梗死、脑出血、短暂性脑缺血发作和蛛网膜下腔出血等有上述表现者，可参考此内容辨证论治。（一）风痰入络证：【症状】肌肤不仁，手足麻木，突然发生口眼斜，语言不利，口角流涎，舌强语謇，甚则半身不遂，或兼见手足拘挛，关节酸痛等症。舌苔薄白，脉浮数。【中成药应用】常用中成药有大活络丸、再造丸、豨蛭络达胶囊。（二）风阳上扰证：【症状】平素头晕头痛，耳鸣目眩，突然发生口眼斜，舌强语謇，或手足重滞，甚则半身不遂。舌质红苔黄，脉弦。【方剂应用】基础方剂为天麻钩藤饮（天麻、钩藤、生石决明、川牛膝、桑寄生、杜仲、栀子、黄芩、益母草、朱茯神、夜交藤）加减。【中成药应用】常用中成药有心脑静片、松龄血脉康胶囊、全天麻胶囊。（三）气虚血瘀证：【症状】肢体偏枯不用，肢软无力，面色萎黄。舌质淡紫或有瘀斑，苔薄白，脉细涩或细弱。【中成药应用】常用中成药有脉络通颗粒、软脉灵口服液、脑安颗粒、消栓胶囊（A错）、复方地龙胶囊。通天口服液（E错）为瘀血头痛的中成药应用。瘀血头痛：【症状】头痛经久不愈，痛处固定不移，痛如锥刺，或有头部外伤史。舌紫暗，或有瘀斑，瘀点，苔薄白，脉细或细涩。中成药应用为脑心通胶囊（C错）或醒脑再造胶囊（D错）的病证，2022年考试指南未明确说明。